下列原有疾病基础上遭受急性损害后不易发生MODS的是
A. 慢性肾病
B. 风湿性关节炎
C. 糖尿病
D. 肝硬化
E. 冠心病

正确答案：B。风湿性关节炎

解析：风湿性关节炎（B错，为本题正确答案）属于局限性病症，急性损害后，会出现关节疼痛加剧，但不会出现MODS（多器官功能障碍综合征）。慢性肾病（A对）急性损害后会出现肾功能不全甚至衰竭，导致体内代谢废物及毒物不能及时排出，引起水、电解质和酸碱平衡紊乱及各器官功能障碍；糖尿病（C对）急性损害会引起糖尿病酮症酸中毒，引起周围循环衰竭和肾功能障碍而导致MODS；肝硬化（D对）急性损害后会导致肝性脑病、肝肾综合征、肝性肺病等多器官损害；冠心病（E对）急性损害后会引起急性心肌梗死，从而导致心肌以及全身血液灌注不足，引起心源性休克，出现MODS。